药师在工作防范用药错误可以采用的行为，不包括
A. 严格审核处方
B. 仔细核对药品
C. 进行用药指导
D. 自行修改错误处方
E. 规范操作流程

正确答案：D。自行修改错误处方

解析：本题考查防范用药错误应采取的措施。处方经药师审核后方可调配；对处方所列药品不得擅自更改（D错，为本题正确答案）或者代用。药品调配环节需仔细核对药品（B对），规范操作（E对）。审核处方（A对），确认无误后调配；每次配方尽可能1次完成；按处方顺序调配和码放药品；配药后核对，核对的内容包括药名、规格、数量、标签和包装。